青少年牙周炎牙齿移位方向是
A. 上切牙唇侧移位
B. 下切牙唇侧移位
C. 上切牙远中移位
D. 下切牙远中移位
E. 上、下切牙唇侧远中移位

正确答案：E。上、下切牙唇侧远中移位

解析：本题考查局限侵袭性牙周炎的牙齿移位方向。局限侵袭性牙周炎又叫青少年牙周炎，牙周病变局限于切牙和第一恒磨牙，至少2颗恒牙有邻面附着丧失，其中1颗是第一磨牙，非第一磨牙和切牙不超过2个。青少年牙周炎早期出现牙齿松动和移位，在炎症不明显的情况下，患牙可出现松动，咀嚼无力。切牙可向唇侧远中移位（E对ABCD错），呈扇形散开排列，出现牙间隙，多见于上切牙。